通过滑石粉炒达到降低毒性目的的中药是
A. 鳖甲
B. 五灵脂
C. 蕲蛇
D. 水蛭
E. 蛤蚧

正确答案：D。水蛭

解析：本题考查滑石粉炒的目的。滑石粉炒的目的①使药物质地酥脆，便于粉碎和煎煮，如黄狗肾等。②降低毒性及矫正不良气味，如刺猬皮、水蛭（D对）等。醋鳖甲（A错）：取砂置炒制容器内，用武火加热至滑利状态，容易翻动时，投入大小分档的净鳖甲，炒至外表淡黄色，质酥脆时，取出，筛去砂，趁热投入醋液中稍浸，捞出，干燥，捣碎。醋炙的主要目的①降低毒性，缓和药性。如甘遂、京大戟、芫花、商陆等。②引药入肝，增强活血止痛作用。如乳香、没药、三棱、莪术等。③矫臭矫味。如乳香、没药、五灵脂（B错）等。蕲蛇（C错）味甘、咸，性温，有毒。除去头、鳞，可除去毒性。①生品气腥，不利于服用和粉碎，临床较少应用。②酒炙蕲蛇能增强祛风、通络、止痉的作用，并可矫味，减少腥气，便于粉碎和制剂，临床多用酒制品。蛤蚧（E错）味咸，性平。归肺、肾经。具有补肺益肾，纳气定喘，助阳益精的功能。①蛤蚧生品和酥炙品功用相同，酥制后易粉碎，腥气减少。其功效以补肺益精，纳气定喘见长，常用于肺虚咳嗽或肾虚作喘。②酒蛤蚧质脆易碎，矫臭矫味，可增强补肾壮阳作用，多用于肾阳不足，精血亏损的阳痿。